在接触患者后5天内注射丙种球蛋白可预防的疾病是
A. 麻疹
B. 风疹
C. 幼儿急疹
D. 咽-结合膜热
E. 猩红热

正确答案：A。麻疹